《药品流通监督管理办法》规定，药品生产企业不可以
A. 销售本企业药品
B. 销售委托生产的药品
C. 通过邮寄向公众销售药品
D. 通过互联网销售药品
E. 在博览会上以现货销售药品

正确答案：B、C、D、E。销售委托生产的药品；通过邮寄向公众销售药品；通过互联网销售药品；在博览会上以现货销售药品

解析：本题考查药品经营管理。《药品流通监督管理办法》规定，药品生产企业不可以销售委托生产的药品（B对）、不可以通过邮寄向公众销售药品（C对）、不可以通过互联网销售药品（D对）、不可以在博览会上以现货销售药品（E对）。药品生产企业只能销售本企业生产的药品（A错）。